金瓷冠唇面龈边缘一般为
A. 0.5mm肩台
B. 1mm肩台
C. 1.2mm肩台
D. 1.5mm肩台
E. 以上都不是

正确答案：B。1mm肩台

解析：本题考查金瓷冠唇面龈边缘。金瓷冠唇侧龈边缘为1.0mm（B对）时，就可以为金瓷提供足够的空间，且处于牙体预备量的安全范围内，不会导致露髓，故1.0mm是金瓷冠唇侧龈边缘合适的肩台宽度（E错）。当预备的龈边缘肩台为0.5mm（A错），用金瓷冠修复时，患牙无法为修复体提供足够的空间，则烤瓷冠的瓷层或金属层厚度不足，易导致崩瓷或冠破裂。当金瓷冠唇面龈边缘肩台超过1mm（CD错）时，牙体预备量过多，没有必要。